某男，69岁，患风湿性关节炎，症见腰脊疼痛，四肢关节冷痛。证属寒湿闭阻经络。治当温经散寒，通络止痛，宜选用的成药是
A. 天麻丸
B. 木瓜丸
C. 痛风定胶囊
D. 尪痹颗粒
E. 风湿骨痛胶囊

正确答案：E。风湿骨痛胶囊

解析：本题考查的是风湿痛骨胶囊的功能。患风湿性关节炎，症见腰脊疼痛，四肢关节冷痛。证属寒湿闭阻经络。治当温经散寒，通络止痛，宜选用的成药是风湿骨痛胶囊（E对）。风湿痛骨胶囊：【功能】温经散寒，通络止痛。天麻丸（A错）：【功能】祛风除湿，通络止痛，补益肝肾。木瓜丸（B错）：【功能】祛风散寒，除湿通络。痛风定胶囊（C错）：【功能】清热祛湿，活血通络定痛。蠲痹颗粒（D错），2022年考试指南未明确说明。蠲痹颗粒：【功能】温经散寒、祛风除湿、通络止痛。